预防破伤风最好的方法是
A. 受伤后服存命汤
B. 受伤后服玉真散
C. 按一定的方法注射破伤风类毒素
D. 彻底清创
E. 清创加口服蝉衣

正确答案：C。按一定的方法注射破伤风类毒素

解析：自动免疫法，即注射破伤风类毒素（C对），是预防破伤风最可靠的方法。破伤风类毒素刺激机体产生抗体，在体内较长时间保持一定浓度，可以中和进入体内的破伤风毒素而不至发病，从而获得自动免疫。